构成流行过程必需具备的条件是
A. 传染源、传播途径、易感人群
B. 病原体、人体、环境
C. 社会因素、自然因素、病原体
D. 病原体的数量、致病力、特异定位
E. 屏障作用、体液及吞噬细胞作用

正确答案：A。传染源、传播途径、易感人群